下列腧穴中，归经错误的是
A. 合谷一大肠经
B. 太溪一肝经
C. 列缺一肺经
D. 阳陵泉一胆经
E. 阴陵泉一脾经

正确答案：B。太溪一肝经

解析：该题考查穴位归经，属理解记忆内容。太溪穴属于足少阴肾经的腧穴（B错，为本题正确答案）。记忆：按大纲要求掌握的本经穴位，涌泉、然谷、太溪、照海、复溜。泉水谷水溪水海水都溜走了，记忆时想到四水就想到肾经了。